有关平流层特征及卫生学意义哪一项论述是错误的
A. 平流层在对流层之上
B. 平流层又分两个亚层：同温层和臭氧层
C. 臭氧层能吸收短波紫外线，保护人体不受短波紫外线伤害
D. 同温层在臭氧层下面
E. 各种气象现象都是在平流层中发生

正确答案：E。各种气象现象都是在平流层中发生

解析：本题考查平流层特征及卫生学意义。平流层位于对流层之上（A对），其上界伸展至约55km处。平流层又分两个亚层：同温层和臭氧层（B对），同温层位于臭氧层下面（D对），臭氧层位于同温层上面。臭氧层能吸收短波紫外线，保护人体不受短波紫外线伤害（C对）。各种气象现象都是在对流层中发生（E错，为本题正确答案）。